吗啡的适应症是
A. 分娩止痛
B. 支气管哮喘
C. 心源性哮喘
D. 颅脑外伤疼痛
E. 感染性腹泻

正确答案：C。心源性哮喘